用于祛痰的要穴是
A. 内庭
B. 足三里
C. 丰隆
D. 上巨虚
E. 下巨虚

正确答案：C。丰隆

解析：丰隆为祛痰要穴（E对）。内庭为荥穴，主要治疗热病（A错）。肚腹三里留，足三里主要胃肠和下肢病证，有强壮作用（B错）。上巨虚为大肠下合穴，主要治疗胃肠疾病和下肢痿痹（D错）。下巨虚为小肠下合穴，主要治疗胃肠病症，下肢痿痹，乳痈（E错）。